心动周期中左心室容积最大的时期是
A. 快速射血期末
B. 快速充盈期末
C. 减慢充盈期末
D. 减慢射血期末
E. 房缩期末

正确答案：E。房缩期末

解析：心动周期中：心室舒张期可分为等容舒张期、快速充盈期、减慢充盈期和心房收缩期；心室收缩期可分为等容收缩期、快速射血期、减慢射血期。在心室舒张期的最后0.1秒，进入心房收缩期，使心室进一步充盈，因此心动周期中左心室容积最大的时期是房缩期末（E对）。